膀胱
A. 膀胱三角的粘膜皱襞多而密
B. 膀胱尖朝向前下方
C. 膀胱底呈三角形，朝向后下方
D. 以上都对
E. 无

正确答案：C。膀胱底呈三角形，朝向后下方

解析：空虚的膀胱呈三棱锥体形，分尖、体、底和颈四部。膀胱尖朝向前上方（B错），膀胱底朝向后下方，呈三角形（C对）。在膀胱底内面有一始终保持平滑的区域为膀胱三角（A错）。